设计双端固定桥时，增加基牙主要目的是
A. 为了分担Ⅱ度以上松动基牙的负担
B. 为了尽量分散（牙合）力；把基牙负担降到最小限度
C. 为了减轻弱侧基牙的负荷以分散（牙合）力
D. 为了对称美观
E. 以上都是

正确答案：C。为了减轻弱侧基牙的负荷以分散（牙合）力

解析：双端固定桥两端的固位力应基本相等，若两端的固位力相差悬殊，则固位力弱的一端固位体易松动。其后果是松动端固定桥基牙产生继发龋，甚至损及牙髓，而稳固端基牙的牙周组织往往也受到损害。若一端固位体的固位力不足时，首先应设法提高固位力，必要时增加桥基牙数目，以达到与另一端固位体的固位力相均衡。掌握“固定桥的生理基础”知识点。